有研究者对吸烟与心血管疾病的关系做如下研究，吸烟者发生心血管疾病的发病率是300/10万人年，不吸烟者的发病率是100/10万人年，总人群的心血管发病率是150/10万人年。吸烟与疾病的相对危险度是
A. 3
B. 2
C. 6
D. 0.33
E. 0.67

正确答案：A。3

解析：本题考查相对危险度。相对危险度是指暴露组（300/10万人年）发病或死亡的危险是非暴露组（100/10万人年）的多少倍（300/100＝3）（A对BCDE错），即两组危险度之比。